维持心肌和神经肌肉的正常应激性，须静脉滴注给药的电解质是
A. 氯化钙
B. 氯化钠
C. 硫酸镁
D. 氯化钾
E. 氯化铵

正确答案：D。氯化钾

解析：本题考查氯化钾。维持心肌和神经肌肉的正常应激性，须静脉滴注给药的电解质是氯化钾（D对）。氯化钙（A错）可用于低钙血症、高钾血症、高镁血症和解救镁盐中毒等。氯化钠（B错）主要是调节体液的渗透压和电解质的平衡。硫酸镁（C错）可抑制中枢神经的活动。氯化铵（E错）主要用于代谢性碱中毒。